患者，男，45岁。关节肌肉疼痛，屈伸不利，疼痛较剧，痛有定处，遇寒痛增，得热痛减，局部皮色不红，触之不热，舌苔薄白，脉弦紧。治疗除选用阿是穴、局部经穴外，还应选用的穴位是
A. 肾俞、关元
B. 阴陵泉、足三里
C. 大椎、曲池
D. 膈俞、关元
E. 膈俞、血海

正确答案：A。肾俞、关元

解析：本题考查常见的病症的辩证、处方。题中患者以关节肌肉疼痛，屈伸不利为主症，故诊断为痹证。疼痛较剧，痛有定处，遇寒痛增，得热痛减，局部皮色不红，触之不热，舌苔薄白，脉弦紧均为寒邪内盛之象，故辨为痛痹。痛痹常配肾俞、腰阳关以益火之源，振奋阳气，从而祛除寒邪，关元穴功能培元固本，补益下焦，振奋阳气，亦可选用（A对）。阴陵泉、足三里为着痹的配穴（B错）。大椎、曲池为热痹的配穴（C错）。膈俞能活血，不用于痛痹（D错）。膈俞、血海为行痹的配穴（E错）。